因接种单位违反预防接种工作规范、免疫程序、疫苗指导原则、接种方案给受种者造成损害的
A. 依照药品管理法的有关规定处理
B. 依照医疗事故处理条例的有关规定处理
C. 参照《传染病防治法》执行
D. 参照《医疗事故处理条例》执行
E. 依照医疗机构管理条例的有关规定处理

正确答案：B。依照医疗事故处理条例的有关规定处理